某女，32岁，喘咳气急，胸闷，咳痰稀白，伴头痛、恶寒、口不渴，苔薄白，脉浮紧，治疗应选用
A. 麻杏石药汤
B. 桑白皮汤
C. 二陈汤
D. 补肺汤
E. 麻黄汤

正确答案：E。麻黄汤

解析：风寒上受，内合于肺，邪实气壅肺气不宣故见喘咳气急，胸闷；寒邪伤肺，凝液成痰，故见咳痰稀白；风寒束表，皮毛闭塞故见头痛、恶寒、口不渴；苔薄白、脉浮紧，均为风寒犯肺证之侯，治法为宣肺散寒，化痰止咳，方药选用麻黄汤加减（E对）。麻杏石药汤（A错）可以清热解表，止咳平喘，用于治疗风热犯肺证。桑白皮汤（B错）可以清热化痰，宣肺止咳，用于治疗痰热郁肺证。二陈汤（C错）可以燥湿化痰，降气止咳，用于治疗痰浊阻肺证。补肺汤（D错）可以补肺益气，化痰止咳，用于治疗肺气虚证。